霍乱传播途径不包括
A. 空气
B. 水
C. 食物
D. 生活接触
E. 苍蝇

正确答案：A。空气

解析：霍乱是由霍乱弧菌引起的烈性肠道传染病，患者及带菌者的粪便或排泄物污染水源（B对）或食物（C对）后可引起霍乱爆发流行。日常接触（D对）和苍蝇（E对）亦起传播作用。霍乱不可通过空气传播（A错，为本题正确答案）。